适用于空气和表面灭菌的方法是
A. ⁶⁰Co-辐射灭菌法
B. 微波灭菌法
C. 紫外线灭菌法
D. 流通蒸汽灭菌法
E. 超声波杀菌法

正确答案：C。紫外线灭菌法

解析：本题考查灭菌方法。适用于空气和表面灭菌的方法是紫外线灭菌法（C对）。紫外线灭菌法：紫外线灭菌法是指用紫外线照射杀灭微生物的方法。本法适用于物品表面的灭菌、无菌室空气及蒸馏水的灭菌；不适用于药液和固体物质深部的灭菌；普通玻璃容器可吸收紫外线，因此装于其中的药物不能用此法灭菌。辐射灭菌法（A错）：以放射性同位素（⁶⁰Co或¹³⁷Cs）放射的γ射线杀菌的方法。辐射灭菌设备费用高，对某些药品可能降低效力、产生毒性或发热物质，同时要注意安全防护等问题。微波灭菌法（B错）：是用微波照射杀灭微生物和芽胞的灭菌方法。此法适用于以水为溶剂的液体药剂、中药饮片及固体制剂的灭菌。具有低温、常压、省时（灭菌速度快，一般为2～3min）、高效、均匀、保质期长（不破坏药物原有成分，灭菌后的药品存放期可增加1/3以上）、节约能源、不污染环境、操作简单、易维护等优点。流通蒸汽灭菌（D错）：是在常压下使用100℃流通蒸汽加热杀灭微生物的方法。通常灭菌时间为30～60min。此法适用于消毒及不耐高热的制剂的灭菌，但不能保证杀灭所有的芽胞，系非可靠的灭菌法，一般可作为不耐热无菌产品的辅助灭菌手段。